下列各项，除哪项外，均为瘀血的致病特点
A. 刺痛拒按
B. 面色紫暗
C. 体内癥块
D. 出血紫暗
E. 易扰神明

正确答案：E。易扰神明

解析：火热易扰神明，火热与心相通应，故火热之邪入于营血，尤易影响心神，轻者心神不宁而心烦、失眠；重者可扰乱心神，出现狂躁不安，或神昏、谵语等症。（E错，为本题正确答案）瘀血致病，虽然症状错综繁多，但其主要特点可大致归纳如下：①疼痛：一般表现为刺痛，痛处固定不移，拒按（A对），夜间痛势尤甚。②肿块：淤血积于皮下或体内则可见肿块，肿块位置多固定不移。若在体表则可见局部青紫肿胀；若在体腔内则扪之质硬，坚固难移之癥积（C对）。③出血：因瘀血阻滞，经脉不畅，血溢脉外而见出血，血色紫黯（D对），或夹有淤血块。④色紫黯：一是面色紫黯（B对），口唇、爪甲青紫等；二是舌质紫黯，或舌有瘀斑、瘀点等。⑤可出现肌肤甲错，脉涩或脉结代等。